下列治法中根据五行相克规律确定的是
A. 培土生金
B. 金水相生
C. 滋水涵木
D. 益火补土
E. 培土制水

正确答案：E。培土制水

解析：本题考查的是根据相克关系确定的治则治法。下列治法中根据五行相克规律确定的是培土制水法（E对）。根据五行相克规律确定的治法，主要有抑木扶土法、培土制水法、佐金平木法、泻南补北法等。根据相生规律确定的治法，主要有滋水涵木法（C错）、培土生金法（A错）、金水相生法（B错）、益火补土法（D错）等